下列说法正确的有
A. 某些外源化学物在一次暴露后的短时间所引起的即刻毒作用称为速发性毒作用。
B. 在一次或多次暴露某种外源化学物后，经一定时间间隔才出现的毒作用称为速发性毒作用。
C. 局部毒作用是指某些外源化学物在机体暴露部位间接造成的损害作用。
D. 外源化学物的可逆作用是指停止暴露后不可消失的毒作用。

正确答案：A。某些外源化学物在一次暴露后的短时间所引起的即刻毒作用称为速发性毒作用。

解析：本题考查速发性毒作用。速发性毒作用是指某些外源化学物在一次暴露后的短时间内所引起的即刻毒作用（A对BCD错）。如氯气和硫化氢等引起的急性中毒。